阿托品禁用于
A. 膀胱刺激征
B. 中毒性休克
C. 青光眼
D. 房室传导阻滞
E. 麻醉前给药

正确答案：C。青光眼

解析：阿托品属于M受体阻断药，具有扩瞳作用，瞳孔扩大后虹膜退向周围边缘，虹膜根部增厚，前房角间隙变窄，房水回流受阻，房水积聚而引起眼内压升高，禁用于青光眼（C错，为本题正确答案）。阿托品可解除平滑肌痉挛，适用于各种内脏绞痛，对膀胱刺激症状（A对）如尿急、尿频也有较好疗效。大剂量阿托品可解除血管痉挛、舒张外周血管、改善循环，可用于治疗暴发性流行性脑脊髓膜炎、中毒性菌痢、中毒性肺炎等所致的感染性中毒性休克（B对）。阿托品可用于治疗迷走神经过度兴奋所致窦房阻滞、房室阻滞等缓慢性心律失常，也用于窦房结功能低下而出现的房室传导阻滞（D对）。阿托品可抑制腺体分泌。麻醉前给药（E对）用于减少呼吸道腺体分泌及唾液腺的分泌，防止分泌物阻塞呼吸道而引起窒息或吸入性肺炎。